磺胺类药物通过抑制下列哪种酶而起作用
A. 一碳基团转移酶
B. 二氢叶酸还原酶
C. 二氢叶酸合成酶
D. β-内酰胺酶
E. DNA回旋酶

正确答案：C。二氢叶酸合成酶

解析：本题考查磺胺类药物的作用机制。磺胺类药物通过抑制二氢叶酸合成酶（C对）而起作用。一碳基团转移酶（A错）可通过代谢将氨基酸与核苷酸及一些重要物质的生物合成联系起来。二氢叶酸还原酶（B错）可通过催化叶酸使之还原成二氢叶酸，然后将叶酸转换成为四氢叶酸。β-内酰胺类（D错）系指化学结构中具有β-内酰胺环的一大类抗生素。DNA回旋酶（E错）是在水解ATP的同时，能使松弛态环状DNA转变为负超螺旋DNA。